与儿童生长发育及生殖系统发育关系密切的微量元素是
A. 钙和锌
B. 钙和碘
C. 锌和铁
D. 锌和碘
E. 钙和铜

正确答案：D。锌和碘